流行病学的病因定义为
A. 存在时必定引起疾病的因素
B. 对疾病发生必不可少的因素
C. 疾病发生机制中的生物因素
D. 使疾病发生概率升高的因素
E. 引起疾病发生的诸多因素

正确答案：D。使疾病发生概率升高的因素